李某，为中度慢性疼痛患者，医师开具第一类精神药品控缓释制剂，每张处方用药量最多天数
A. 1天
B. 2天
C. 3天
D. 15天
E. 10天

正确答案：D。15天

解析：为门（急）诊癌症疼痛患者和中、重度慢性疼痛患者开具的麻醉药品、第一类精神药品注射剂，每张处方不得超过3日常用量，控缓释制剂，每张处方不得超过15日常用量，其他剂型，每张处方不得超过7日常用量（D对）。